中医学认为，肾病综合征的主要病因病机是
A. 脾肾两虚
B. 肝肾阴虚
C. 肺肾气虚
D. 心脾两虚
E. 气阴两虚

正确答案：A。脾肾两虚

解析：肾病综合征主要表现为肺、脾、肾三脏功能失调，以阴阳气血不足特别是阳气不足为病变之本，以水湿、湿热、风邪、疮毒、淤血等病变为标，为虚实夹杂之证。因外邪而致水肿者，病变部位多责之于肺；因内伤而致水肿或感受外邪久治不愈者多责之于脾肾。早期多实证，日久则虚实夹杂。肾病综合征临床表现为大量蛋白尿，低蛋白血症及水肿，突出表现为水肿。脾肾两虚，致水液代谢功能失调，为肾病综合征的主要病因病机（A对）。肝肾阴虚（B错）、肺肾气虚（C错）、心脾两虚（D错）、气阴两虚（E错）均不是肾病综合征的主要病因病机。